眶下神经阻滞麻醉口外注射法进针方向为
A. 注射针与皮肤成45°，向下、后、外进针
B. 注射针与皮肤成60°，向上、后、外进针
C. 注射针与皮肤成45°，向上、后、外进针
D. 注射针与皮肤成45°，向上、后、内进针
E. 注射针与皮肤成60°，向上、后、内进针

正确答案：C。注射针与皮肤成45°，向上、后、外进针

解析：本题考查眶下神经阻滞麻醉。行眶下神经阻滞麻醉口外注射法时，应使注射针与皮肤呈45°，向上、后、外进针（C对）约1.5cm。注意注射针进入眶下孔不可过深，以防损伤眼球。行阻滞麻醉时如果没有按照要求进针的位置、角度和方向正确操作，注射针有可能刺破血管导致血肿；若注射针刺入神经，可能造成神经损伤，出现感觉异常等。因此阻滞麻醉必须严格按照要求进针的位置、角度和方向操作。